下列有关心理卫生的描述正确的是
A. 以积极有益的教育和措施，维护和改进人们的心理状态，去适应当前和发展的社会环境
B. 个体在“察觉”到环境刺激构成威胁或挑战、必须作出适应或应对时作出的生理、心理及行为的适应性反应过程
C. 依据心理学的理论和方法对人的心理品质及水平所作出的鉴定。所谓心理品质包括心理过程和人格特征等内容
D. 是以一定的理论体系为指导，以良好的医患关系为桥梁，应用心理学的方法，影响或改变病人的认识、情绪及行为，调整个体与环境之间的平衡，从而达到治疗目的的一种方法
E. 神经系统尤其是脑的功能，发育完善的神经系统是各种心理现象发生和发展的基础

正确答案：A。以积极有益的教育和措施，维护和改进人们的心理状态，去适应当前和发展的社会环境

解析：心理卫生，也称心理健康，指以积极有益的教育和措施，维护和改进人们的心理状态，去适应当前和发展的社会环境。掌握“心理健康概述”知识点。